男，75岁。因呼吸衰竭去世。既往病史：记忆力进行性下降，时间定向力障碍，命名不能，双手失用，近6个月完全卧床。脑MRI示双侧海马萎缩。去世后尸检除肺部损伤外，还可见脑组织异常的beta淀粉样斑块。导致这种异常蛋白质形成的生化基础是
A. 蛋白质亚基数目减少
B. 氨基酸的排列顺序改变
C. 编码该蛋白质的基因序列突变
D. 蛋白质某些氨基酸改变
E. 蛋白质空间结构改变

正确答案：E。蛋白质空间结构改变

解析：老年男性，记忆力进行性下降，时间定向力障碍，命名不能，双手失用，近6个月完全卧床。脑MRI示双侧海马萎缩。去世后尸检除肺部损伤外，还可见脑组织异常的beta淀粉样斑块。最可能诊断为AD（九版神经病学P266）。导致这种异常蛋白质形成的生化基础是蛋白质空间结构改变（E对）。